下列哪项不是嗜酸性淋巴肉芽肿的主要特征
A. 嗜酸性粒细胞弥漫性浸润
B. 淋巴细胞灶性浸润
C. 血管增生
D. 大量的泡沫细胞
E. 嗜酸性粒细胞灶性浸润

正确答案：D。大量的泡沫细胞

解析：嗜酸性淋巴肉芽肿病损的主要特征：一是嗜酸性粒细胞和淋巴细胞灶性或弥漫性浸润；二是病变血管增生。掌握“血管瘤及嗜酸性淋巴肉芽肿”知识点。